下列不属于少尿型急性肾衰竭少尿期引起高钾血症原因的是
A. 尿量减少和肾小管功能受损
B. 组织损伤、分解代谢增强
C. 代谢性碱中毒
D. 摄入含钾量高的食物
E. 代谢性酸中毒

正确答案：C。代谢性碱中毒

解析：高钾血症发生的主要原因：①尿量减少和肾小管功能受损（A对）使钾随尿排出减少；②组织损伤和分解代谢增强（B对），使钾大量释放到细胞外液；③酸中毒（E对C错，为本题正确答案）时，细胞内钾离子外逸；④输入库存血或食入含钾量高的食物（D对）或药物等。